学习生理负荷达到临界限度的指标是
A. 疲劳
B. 早期疲劳
C. 显著疲劳
D. 疲倦
E. 过劳

正确答案：B。早期疲劳